患者，男，9岁，因午后低热、乏力、盗汗就诊，诊断为肺结核，可选用的药物有
A. 乙胺丁醇
B. 异烟肼
C. 利福平
D. 左氧氟沙星
E. 对氨基水杨酸

正确答案：B、C、E。异烟肼；利福平；对氨基水杨酸

解析：本题考查肺结核治疗药物。可选用的药物有异烟肼（B对）、利福平（C对）、对氨基水杨酸（E对）。乙胺丁醇、异烟肼、利福平、对氨基水杨酸、左氧氟沙星都是抗结核药物。乙胺丁醇（A错）禁用于13岁以下儿童。左氧氟沙星（D错）禁用于18岁以下儿童。